女，56岁，右利手。突然语言困难2天。有心房颤动病史7年。查体：神志清楚，四肢运动感觉无异常。门诊医生问诊：“生什么病？”答：“呀！吃饭吗？”医生：“把右手举起来。”答：“是”，却向门口走去。最可能的原因是
A. 运动性失语
B. 命名性失语
C. 传导性失语
D. 感觉性失语
E. 混合性失语

正确答案：D。感觉性失语

解析：中老年女性患者，有心房颤动病史，近两天出现答非所问症状，查体：神志清楚，四肢运动感觉无异常。最可能的原因是感觉性失语（D对）。感觉性失语为由优势半球颞上回后部（Wernicke区）病变引起严重听理解障碍，即能说能读能写但听不懂，典型表现为答非所问。运动性失语（Broca失语）（A错）临床表现以口语表达障碍最为突出，即不会说（说话的动作不能完成）（P69）；命名性失语（B错）主要特点是命名不能即不能说出物件或人物的名字（P70）；传导性失语（C错）属于流利性失语的一种，能表达与理解，但语言中有大量错词，自身可感知错误，欲纠正而显得口吃（P69）；混合性失语（E错）指存在多种语言障碍。